着色性干皮病的分子基础是
A. Na⁺泵激活引起细胞失水
B. 温度敏感性转移酶类失活
C. 紫外线照射损伤DNA修复
D. 利用维生素A的酶被光破坏
E. DNA损伤修复所需的核酸内切酶缺乏

正确答案：E。DNA损伤修复所需的核酸内切酶缺乏